HAV患者，粪便中不再排出病毒的时间是
A. 感染后1周内
B. 发病前2周内
C. 发病2周后开始
D. 发病后1个月
E. 发病5～6日后

正确答案：C。发病2周后开始

解析：甲型肝炎的潜伏期为15～50日（平均约30日），病毒常在患者转氨酶升高前5～6日就存在于患者的血液和粪便中。发病后2周开始，粪便中不再排出病毒。掌握“甲型肝炎病毒”知识点。